黄精的主治病症有
A. 肺虚燥咳
B. 须发早白
C. 失眠健忘
D. 内热消渴
E. 目暗不明

正确答案：A、B、D。肺虚燥咳；须发早白；内热消渴

解析：本题考查黄精的主治病证。黄精的主治病症有肺虚燥咳（A对）、须发早白（B对）、内热消渴（D对）。黄精【功效】滋阴润肺，补脾益气。【主治病证】（1）肺虚燥咳，劳嗽久咳。（2）肾虚精亏之腰膝酸软、须发早白、头晕乏力。（3）气虚倦怠乏力，阴虚口干便燥。（4）气阴两虚，内热消渴。龟甲【功效】滋阴潜阳，益肾健骨，养血补心，凉血止血。【主治病证】（1）阴虚阳亢之头晕目眩，热病伤阴之虚风内动。（2）阴虚发热。（3）肾虚之腰膝痿弱、筋骨不健、小儿囟门不合。（4）心血不足之心悸、失眠、健忘（C错）。（5）血热之崩漏、月经过多。决明子【功效】清肝明目，润肠通便。【主治病证】（1）肝热或肝经风热之目赤肿痛、羞明多泪，目暗不明（E错）。（2）热结肠燥便秘。